病毒性心肌炎最常见的致病微生物是
A. 草绿色链球菌
B. 金黄色葡萄球菌
C. EB病毒
D. 巨细胞病毒
E. 柯萨奇B组病毒

正确答案：E。柯萨奇B组病毒

解析：病毒性心肌炎最常见的致病微生物是柯萨奇B组病毒，约占30％~50％（E对）。草绿色链球菌是亚急性心内膜炎最常见的致病菌（A错）。急性心内膜炎主要由金黄色葡萄球菌（B错）。EB病毒感染常见于鼻咽癌（C错）。